成人出现便隐血阳性时，消化道出血量至少大于
A. 10ml
B. 9ml
C. 8ml
D. 6ml
E. 5ml

正确答案：E。5ml

解析：成人出现便隐血阳性时，消化道出血量至少大于5ml（E对）。